不能作为判断幽门螺杆菌根除的检验方法是
A. 活组织幽门螺杆菌培养
B. 组织学检查找幽门螺杆菌
C. ¹³C尿素酶呼气试验
D. 快速尿素酶试验
E. 血清抗幽门螺杆菌抗体检测

正确答案：E。血清抗幽门螺杆菌抗体检测

解析：幽门螺杆菌的检测方法有非侵入性方法如¹³C尿素酶呼气试验（C对）、血清抗幽门螺杆菌抗体检测等和侵入性方法如活组织幽门螺杆菌培养（A对）、组织学检查找幽门螺杆菌（B对）、快速尿素酶试验（D对）等。其中血清抗幽门螺杆菌抗体检测（E错，为本题正确答案）在幽门螺杆菌根除后仍可为阳性，不能作为判断幽门螺杆菌根除的检验方法。其余方法当幽门螺杆菌根除后均为阴性。